某工人从事蓄电池制造工作5年，近来出现头昏、头痛、全身无力、记忆力减退、睡眠障碍、多梦等症状，并出现突发性腹部绞痛，牙齿边缘形成蓝黑色的线。该毒物损害的系统包括
A. 神经系统
B. 消化系统
C. 造血系统
D. 泌尿系统
E. 以上所有系统

正确答案：E。以上所有系统